下列各项，属于行政处罚的是
A. 罚款
B. 降级
C. 赔偿损失
D. 撤职
E. 赔礼道歉

正确答案：A。罚款

解析：行政处罚是指县级以上卫生行政机关依据卫生法律、法规、规章，对应受制裁的违法行为，做出的警告、罚款（A对）、没收违法所得、责令停产停业、吊销许可证以及卫生法律、行政法规规定的其他行政处罚。